女，70岁。因胆总管结石，急症行胆总管探查术后1周。T管每天引流约400～600ml，最可能的原因是
A. 肝脏功能障碍
B. 肝内胆管结石
C. 胆总管T管引流通畅
D. 胆汁引流袋位置过低
E. 胆总管下端不通畅

正确答案：E。胆总管下端不通畅

解析：肝脏每日分泌胆汁800～1000ml，放置T管后，T管引流胆汁正常约1/3，即200～300ml/d。而该患者每天T管引流约400～600ml，引流胆汁过多，考虑胆总管下端不通畅（E对），由于下行不畅，胆汁沿T管流出体外。若肝脏功能障碍（A错），胆汁分泌减少；肝内胆管结石（B错）导致肝脏分泌的胆汁不能出肝，以上情况T管引流会显著减少。胆总管T管引流通畅（C错）多导致胆汁引流过少或无胆汁引出。胆汁引流袋位置过低（D错）对引流量无明显影响。